关于药品包装、标签和说明书的说法，错误的是
A. 处方药、非处方药、外用药、特殊管理的药品等专用标识在说明书首页的右上方标注
B. 药品包装应当适合药品质量的要求，方便储存、运输和医疗使用，药品的包装分为内包装和外包装
C. 药品批准文号是鉴别假药的重要依据之一
D. 药品有效期是鉴别劣药的重要依据之一

正确答案：A。处方药、非处方药、外用药、特殊管理的药品等专用标识在说明书首页的右上方标注

解析：本题考查药品说明书的格式和书写要求。关于药品包装、标签和说明书的说法，错误的是处方药、非处方药、外用药、特殊管理的药品等专用标识在说明书首页的右上方标注（A错，为本题正确答案）。“特殊药品、非处方药、外用药品标识”等专用标识（如有的话）在说明书首页右上方标注。《药品管理法》第四十八条规定，药品包装应当适合药品质量的要求，方便储存、运输和医疗使用。药品的包装分为内包装、外包装和最小销售单元包装（B对）。批准文号是鉴别假药、劣药的重要依据（C对），有效期或失效期为药品质量可以保证的期限（D对）。